下列处方中作为助悬剂的是
A. 醋酸氢化可的松微晶25g
B. 氯化钠8g
C. 吐温3.5g
D. 羧甲基纤维素钠5g
E. 硫柳汞0.01g/制成1000ml

正确答案：D。羧甲基纤维素钠5g

解析：本题考查混悬剂。醋酸氢化可的松溶液处方分析：①主药-醋酸可的松；②抑菌剂-硝酸苯汞；③助悬剂-羧甲基纤维素钠（D对）；④表面活性剂-吐温80；⑤渗透压调节剂-硼酸；⑥溶剂-蒸馏水。助悬剂系指能增加分散介质的黏度以降低微粒的沉降速度或增加微粒亲水性的附加剂。常用的助悬剂有：（1）低分子助悬剂。如甘油、糖浆剂等，在外用混悬剂中常加入甘油。（2）高分子助悬剂。①天然的高分子助悬剂，如阿拉伯胶、西黄蓍胶、桃胶、海藻酸钠、琼脂、淀粉浆等；②合成或半合成高分子助悬剂，如甲基纤维素、羧甲纤维素钠、羟丙纤维素、卡波姆、聚维酮、葡聚糖等。③硅皂土。④触变胶。醋酸氢化可的松微晶25g（A错）为主药。氯化钠8g（B错）为渗透压调节剂。吐温3.5g（C错）为润湿剂。硫柳汞0.01g（E错）为防腐剂。